制作鸠尾扣的主要目的是
A. 避免意外穿髓
B. 最大限度地保留天然牙齿组织
C. 便于恢复邻接关系
D. 防止充填物在咀嚼过程中发生水平脱落

正确答案：D。防止充填物在咀嚼过程中发生水平脱落

解析：本题考查鸠尾固位。鸠尾是一种机械固位结构，鸠尾固位形的外形似斑鸠的尾部，由鸠尾峡和膨大的尾部组成，借助于峡部的扣锁作用防止充填物在咀嚼过程中发生水平脱落（D对）。窝洞预备过程中了解髓腔的解剖形态和结构变异，操作恰当可避免意外穿髓（A错）。尽量不做预防性扩展可最大限度地保留天然牙齿组织（B错）。牙体充填时用成型片和小楔子便于恢复邻接关系（C错）。